患者，女，36岁。昏倒在公园一角被人发现，身旁散在药瓶。查体：神志不清，针尖样瞳孔，洗胃液有蒜臭味。应首先考虑的是
A. 急性安眠药物中毒
B. 急性毒蕈中毒
C. 急性有机磷农药中毒
D. 亚硝酸盐中毒
E. 一氧化碳中毒

正确答案：C。急性有机磷农药中毒

解析：有机磷农药中毒患者的口腔里面会出现大蒜味，主要是有机磷农药进入身体以后会被分解代谢产生一些有大蒜味道的成分，这些成分可以存在于消化系统和呼吸系统当中，可以随着呼吸运动排出而被人闻到（C对）。急性安眠药中毒、急性毒蕈中毒、亚硝酸盐中毒、一氧化碳中毒均无此类表现（ABDE错）。